一般来说，流行病学研究的起点是
A. 描述性研究
B. 病例对照研究
C. 队列研究
D. 流行病学实验研究
E. 分析性研究

正确答案：A。描述性研究